下面关于肾外途径过度失钾的原因，哪一项是不正确的？
A. 呕吐、腹泻
B. 胃肠减压
C. 钡中毒
D. 肠瘘
E. 过量发汗

正确答案：C。钡中毒

解析：呕吐、腹泻（A对）、胃肠减压（B对）、肠瘘（D对）、过量发汗（E对）引起低钾血症的原因都是钾经消化道或皮肤大量丢失，钡中毒（C错，为本题正确答案）是由于钾通道被阻滞，使K＋外流减少导致低钾血症。